艾滋病病毒的特点是
A. 耐高温
B. 不耐高温
C. 在唾液中的浓度高
D. 在体外容易生存
E. 只在血液和精液中

正确答案：B。不耐高温

解析：本题考查艾滋病病毒的特点。艾滋病病毒的特点是不耐高温（B对）。艾滋病病毒又称人类免疫缺陷病毒，它通过破坏人体的T淋巴细胞，进而阻断细胞免疫和体液免疫过程，导致免疫系统瘫痪，从而致使各种疾病在人体内蔓延，最终导致艾滋病。该病毒对热敏感，56℃环境下30分钟即可灭活，不耐高温（B对A错）。病毒可广泛存在于患者的血液、精液、子宫和阴道分泌物、唾液、泪液、乳汁、尿液、脑脊液、羊水中（E错），其中以血液、精液、阴道分泌物中浓度最高，在唾液中浓度相对较低（C错）。该病毒离开人体生存能力极差，在体外不易生存（D错）。